病毒性心肌炎心阳虚弱证治疗首选方剂是
A. 桂枝甘草龙骨牡蛎汤
B. 炙甘草汤合生脉散
C. 黄芪桂枝五物汤
D. 炙甘草汤
E. 参附汤

正确答案：A。桂枝甘草龙骨牡蛎汤

解析：病毒性心肌炎心阳虚弱证治疗首选方剂是桂枝甘草龙骨牡蛎汤心阳虚弱证由病久外邪损伤心阳，或素体虚弱，复感外邪，心阳不振所致。临床以心悸怔忡，畏寒肢冷，脉缓无力为特征。应温振心阳，宁心复脉。选方桂枝甘草龙骨牡蛎汤加减（A对）。病毒性心肌炎气阴两虚证治疗首选方是炙甘草汤合生脉散（B错）。黄芪桂枝五物汤主治血痹，肌肤麻木不仁，脉微涩而紧（C错）。炙甘草汤主治阴血阳气虚弱，心脉失养证（D错）。参附汤主治元气大亏，阳气暴脱，汗出粘冷，四肢不温，呼吸微弱，或上气喘急，或大便自利，或脐腹疼痛，面色苍白，脉微欲绝（E错）。